毒性较大，尤其对第八对脑神经和肾损害严重的药物是
A. 卡那霉素
B. 对氨基水杨酸
C. 利福平
D. 异烟肼
E. 乙胺丁醇

正确答案：A。卡那霉素

解析：本题考查卡那霉素的不良反应。卡那霉素（A对）为氨基糖苷类抗菌药物，毒性较大，尤其对第八对脑神经和肾损害严重。对氨基水杨酸（B错）不良反应为食欲减退、腹痛、腹泻、瘙痒、哮喘、嗜酸性粒细胞增多。利福平（C错）不良反应为肝脏转氨酶AST及ALT升高。异烟肼（D错）不良反应主要为肝脏毒性及周围神经炎。乙胺丁醇（E错）常见视物模糊、眼痛、红绿色盲或视力减退、视野缩小。